能伤津伐胃的味是
A. 辛
B. 酸
C. 甘
D. 苦
E. 淡

正确答案：D。苦

解析：本题考查五味的所示效用及临床应用。能伤津伐胃的味是苦（D对）。苦味药大多能伤津、伐胃，津液大伤及脾胃虚弱者不宜大量用。辛（A错）味药大多能耗气伤阴，气虚阴亏者慎用。酸（B错）味药大多能收敛邪气，凡邪未尽之证均当慎用。甘（C错）味药大多能腻膈碍胃，令人中满，凡湿阻、食积、中满气滞者慎用。淡（E错）味药过用，亦能伤津液，阴虚津亏者慎用。‘